直线回归方程主要的应用有
A. 估计a，b的值
B. 判断是否直线相关
C. 确定x，y间存在的因果关系
D. 进行预测
E. 绘制散点图

正确答案：D。进行预测